激素的第二信使不包括
A. PIP₂
B. cAMP
C. DAG
D. Ca²⁺
E. IP₃

正确答案：A。PIP₂

解析：激素属于外源信号分子，第二信使是指外源信息在细胞内的信号转导分子，包括：cAMP（环腺苷酸）（B对）、cGMP（环鸟苷酸）、DAG（甘油二酯）（C对）、IP₃（三磷酸肌醇）（E对）、PIP₃（磷脂酰肌醇-3，4，5三磷酸）、Ca²⁺（D对）等。PIP₂（A错，为本题正确答案））的分解产物DAG与IP₃均为第二信使（P385），其本身并非第二信使。